主宰人体生长发育功能的脏是
A. 肺
B. 肾
C. 肝
D. 脾
E. 心

正确答案：B。肾

解析：肾藏精，主生长发育与生殖；肾精、肾气具有促进机体生长发育的作用，故（B对）；肺主气，司呼吸（A错），肺主呼吸之气，肺主一身之气，肺主通调水道，肺朝百脉。肝主疏泄，调畅气机，主藏血，指贮藏血液、调节血量和防止出血（C错），脾主运化，运化谷食、运化水饮，主统血，统摄血液运行于脉中，不使其逸出于脉外（D错）。心主血脉，心主神明（E错）。